能增强止血作用常用的配伍是
A. 白薇配玉竹
B. 白及配海螵蛸
C. 桑白皮配地骨皮
D. 薤白配全瓜蒌
E. 白花蛇舌草配半枝莲

正确答案：B。白及配海螵蛸

解析：本题考查的是白及的配伍。能增强止血作用常用的配伍是白及配海螵蛸（B对）。白及：【配伍】白及配三七：白及微寒黏涩，功善收敛止血、消肿生肌；三七性温，功善化瘀止血、消肿定痛，且不伤正。两药相配，行止并施，止血力增强而不留瘀，可治各种出血，内服外用皆宜。白及配海螵蛸：白及微寒黏涩，功能收敛止血、生肌；海螵蛸微温燥涩，功能收敛止血、制酸止痛、敛疮。两药相配，功能收敛止血、生肌敛疮，治胃、十二指肠溃疡之吐血、便血效佳。白薇配玉竹（A错）：白薇性寒，功能退虚热兼透散益阴；玉竹性平，功能滋阴生津而不甚滋腻。两药相配，既滋阴又透表，治阴虚外感每选。地骨皮配桑白皮（C错）：地骨皮甘寒，功能清泄肺火，并兼益阴；桑白皮甘寒，功能清热泻肺平喘，并兼利尿。两药相配，既清肺火，又利尿导热邪从小便出，且润肺脏而不苦泄伤阴，故治肺热咳嗽每用。薤白配瓜蒌（D错）：薤白辛苦而温，善通阳散结、下气导滞；瓜蒌甘微苦而寒，善清热化痰、宽胸散结，兼润肠通便。两药相配，既化痰散结，又宽胸通阳，故治痰浊闭阻、胸阳不振之胸痹证。白花蛇舌草配半枝莲（E错）的功效，2022年考试指南未明确说明。